男，高热伴皮肤淤斑1周。查体：T39℃，胸部和下肢可见淤斑，浅表淋巴结不大，巩膜部分黄，胸骨压痛，右下肺可及少许啰音，心率110次/分，律齐，腹软，肝脾未及。检查：Hb75g/L，WBC2.8×10⁹/L，Plt20×10⁹/L，骨穿示增生极度活跃，见大量细胞胞浆内有粗大颗粒，易见Auer小体，呈柴团状，POX染色阳性和强阳性。最可能诊断是
A. 急性淋巴细胞白血病
B. 急性单核细胞白血病
C. 急性粒单核细胞白血病
D. 急性早幼粒细胞白血病
E. 急性巨核细胞白血病

正确答案：D。急性早幼粒细胞白血病

解析：患者男性，高热伴皮肤瘀斑1周，查体：T39℃，胸部和下肢可见瘀斑（感染、出血表现），胸骨压痛（白血病细胞浸润的表现），检查：Hb75g/L（成年男性Hb正常值120～160g/L），提示贫血，WBC2.8×10⁹/L（正常4～10×10⁹/L）减低，Plt20×10⁹/L（正常100～300×10⁹/L）明显减少，骨穿示增生极度活跃，见大量细胞胞浆内有粗大颗粒（早幼粒细胞的特点），易见Auer小体（见于急非淋白血病），呈柴团状，POX染色阳性或强阳性（见于急性粒细胞白血病、急性早幼粒细胞白血病），故患者最可能的诊断是急性早幼粒细胞白血病（D对）。急性淋巴细胞白血病（A错）常见肝脾、淋巴结肿大，无Auer小体，POX染色阴性；急性单核细胞白血病（B错）可见Auer小体，但POX染色阴性或弱阳性；急性粒单核细胞白血病（C错）POX染色可阳性，但细胞胞浆中无粗大颗粒；急性巨核细胞白血病（P569）（E错）血小板抗原阳性，血小板过氧化酶阳性。